保护儿童青少年视力的核心是
A. 预防近视
B. 防治弱视
C. 预防远视
D. 坚持做眼保健操
E. 注意用眼卫生

正确答案：A。预防近视